望神重点是观察
A. 面色
B. 神情
C. 两目
D. 形体
E. 姿态

正确答案：C。两目

解析：《医原·望病须察神气论》云“人之神气，栖于二目”，说明两目最易传神。目为五脏六腑精气汇聚之地，目系通于脑，其活动直接受心神支配，所以观察两目对于望神显得尤为重要（C对）。人体面部皮肤的色泽（A错）是神气外现的重要征象。神情（B错），是精神意识和面部表情的综合体现，是心神和脏腑精气盛衰的外在表现。人体的形体（D错）姿态（E错）是反映神之盛衰的主要标志之一。